不参与ADCC作用的免疫分子是
A. 补体
B. Fc受体
C. 免疫球蛋白
D. 颗粒酶
E. 穿孔素

正确答案：A。补体

解析：ADCC效应指IgG类抗体与靶细胞（如肿瘤或病毒感染细胞）表面相应抗原表位特异性结合后，通过Fc段与ＮＫ细胞、中性粒细胞、巨噬细胞等效应细胞表面相应IgFc受体结合，增强或触发上述效应细胞对靶细胞的杀伤破坏作用。NK细胞通过穿孔素/颗粒酶，Fas/FasL途径等杀伤机制杀伤某些肿瘤或病毒感染细胞，通过ADCC效应杀伤靶细胞。补体旁路途径激活后可产生多种补体裂解片段：C3b、C4b具有调理作用和免疫粘附作用，可促进吞噬细胞对病原体和抗原-抗体复合物的清除，而非通过Fc段与NK细胞、中性粒细胞、巨噬细胞等效应细胞表面相应IgFc受体结合不属于ADCC效应（A对）。